男，35岁。间断发作腰痛伴右下肢麻木3年。CT提示中央型腰椎间盘突出症，经保守治疗缓解。近1个月症状逐渐加重，2小时前出现大小便障碍。首选的治疗方法是
A. 糖皮质激素硬膜外注射
B. 绝对卧床休息
C. 髓核摘除术
D. 持续牵引
E. 理疗和按摩

正确答案：C。髓核摘除术

解析：患者青年男性，间断发作腰痛伴右下肢麻木3年（腰椎间盘突出常见症状）。CT提示中央型腰椎间盘突出症（中央型腰椎间盘突出典型影像学表现），经保守治疗缓解。近1个月症状逐渐加重，2小时前出现大小便障碍（腰椎间盘突出症急性加重并出现手术适应证）应立行髓核摘除术（C对）。糖皮质激素硬膜外注射（A错）绝对卧床休息（B错）、持续牵引（D错）、理疗和按摩（E错）均属于保守辅助治疗，并不能解决病因，不作为首选治疗方法。